蒲黄的鉴别特征有
A. 为鲜黄色粉末
B. 体轻，放水中则漂浮于水面
C. 手捻易附着手指上
D. 味极苦
E. 花粉粒外壁具细刺状突起，萌发孔3个

正确答案：A、B、C。为鲜黄色粉末；体轻，放水中则漂浮于水面；手捻易附着手指上

解析：本题考查蒲黄的性状鉴别。蒲黄的鉴别特征有为鲜黄色粉末（A对）、体轻，放水中则漂浮于水面（B对）、手捻易附着手指上（C对）。蒲黄【性状鉴别】为鲜黄色粉末，体轻，手捻有滑腻感，易附于手指上，放水中则飘浮水面。气微，味淡。以粉细、质轻、色鲜黄、滑腻感强者为佳。花粉粒黄色，呈类圆形或椭圆形，直径17～29㎛，表面有似网状雕纹，周边轮廓线光滑，呈凸波状或齿轮状，单萌发孔不甚明显。黄连【性状鉴别】饮片：呈不规则的薄片。外表皮灰黄色或黄褐色，粗糙，有细小的须根。切面或碎断面鲜黄色或红黄色，具放射状纹理，气微，味极苦（D错）。豨莶草【显微鉴别】腺梗豨莶叶及花梗表面制片：①上表皮细胞较规则，下表皮细胞垂周壁呈波状弯曲，气孔不定式。②花梗表皮着生有两种腺毛，一种具多细胞柄及多细胞头；另一种具单细胞头及多细胞柄，两种腺毛的柄部细胞均排列成2行。③非腺毛，一种较长，长900～1500㎛；另一种较短，长160～450㎛。④花粉粒圆形，直径18～32㎛，表面具有较密的刺状突起，具萌发孔3个（E错）。